关于小儿急性阑尾炎，错误的是
A. 病情发展快且重
B. 右下腹体征明显
C. 穿孔率达30%
D. 并发症及死亡率较高
E. 宜早期手术

正确答案：B。右下腹体征明显

解析：小儿阑尾腔相对较大而壁较薄，肌层组织和大网膜均未发育成熟，一旦感染，病情发展快且重（A对），极易发生坏疽、穿孔，穿孔率可达30％（C对），但右下腹体征不明显、不典型（B错，为本题正确答案）；另一方面，小儿抗病能力明显差于成人，因此术后并发症和死亡率较高（D对）。综上，小儿急性阑尾炎病情重、发展快，体征不典型，并发症和死亡率高，因此宜早期手术治疗（E对）。